糖尿病病人最基础的治疗措施是
A. 饮食治疗
B. 适当体育锻炼
C. 双胍类降血糖药
D. 磺脲类降血糖药
E. 胰岛素

正确答案：A。饮食治疗

解析：糖尿病为多病因引起的以慢性高血糖为基础的代谢性疾病，其胰岛B细胞功能减退多为不可逆性。目前多提倡糖尿病综合管理治疗即有“五驾马车”之称的：糖尿病教育、医学营养治疗、运动治疗、血糖监测和药物治疗。其中，医学营养治疗即饮食治疗（A对）为最基础的治疗。